胎盘与宫壁界限不清
A. 胎盘滞留
B. 胎盘粘连
C. 胎盘剥离不全
D. 胎盘嵌顿
E. 胎盘植入

正确答案：E。胎盘植入

解析：胎盘植入（E对）是指胎盘绒毛在其附着部位与子宫肌层紧密连接，从而使胎盘与宫壁界限不清。胎盘滞留（A错）是指胎盘没有完全排出而有一部分留存在子宫内部。胎盘粘连（P211）（B错）是指胎盘绒毛黏附于子宫肌层表面。胎盘剥离不全（P211）（C错）是由于第三产程过早牵拉脐带或按压子宫，影响胎盘正常剥离，但胎盘与宫壁已部分分开。胎盘嵌顿（P211）（D错）是由于子宫收缩药物应用不当，宫颈内口附近子宫肌出现环形收缩，使已剥离的胎盘嵌顿于宫腔，此时胎盘已从子宫壁剥离。